手术应加压包扎的是
A. 游离皮瓣移植术
B. 中厚断层皮片移植术
C. 皮瓣成形术
D. 旋转推进皮瓣术后
E. 隧道式皮瓣转移术

正确答案：B。中厚断层皮片移植术

解析：本题考查皮肤移植-游离皮片移植。手术应加压包扎的是中厚断层皮片移植术（B对）。严格的加压固定和彻底止血是中厚断层皮片移植术植皮成活的关键。游离皮瓣移植术（A错）、旋转推进皮瓣术（D错）与隧道式皮瓣移植术（E错）都属于皮瓣移植术。皮瓣移植术，缝合后要适当包扎，不能压迫蒂部，避免影响血液的供应，造成血运障碍，使移植失败。皮瓣形成术（C错）用的也是皮瓣，同样不应加压包扎。